中药二级保护品种在保护期满后可延长期限是
A. 6个月以内
B. 一年以内
C. 5年
D. 7年
E. 分别为30年、20年、10年

正确答案：D。7年

解析：本题考查中药保护品种的保护措施。中药二级保护品种在保护期满后可以延长保护期限，时间为7年（D对），由生产企业在该品种保护期满前6个月，依据条例规定的程序申报。